AFB₁在体内致癌的代谢活化方式为
A. 脱甲基
B. 环氧化
C. 羟化
D. 还原
E. 脱羧基

正确答案：B。环氧化